关于药物制剂稳定性的叙述，正确的是
A. 药物的降解速度与离子强度无关
B. 液体制剂的辅料影响药物稳定性，而固体制剂的辅料不影响药物稳定性
C. 药物的降解速度与溶剂无关
D. 零级反应的速度与反应物浓度无关
E. 经典恒温法适用于所有药物的稳定性研究

正确答案：D。零级反应的速度与反应物浓度无关